男，33岁。因急性坏疽性阑尾炎行阑尾切除，术后第10天出现发热，体温39.2℃，腹胀、恶心，肛门有下坠感，里急后重，曾排便4次，为黏液样便。此时首先应选用的检查是
A. 大便培养
B. 腹部X线平片
C. 血常规
D. 腹部B超
E. 直肠指诊

正确答案：E。直肠指诊

解析：患者阑尾切除后出现发热，肛门下坠感，里急后重（直肠刺激症状），有全身症状，应考虑坐骨肛管间隙脓肿，通过直肠指诊（E对）可触及肠壁外波动感。大便培养费时较长，且本病不引起粪便性状、内容物的特征性改变，对患者诊断意义不大（A错）。下腹部结构复杂，腹部X线平片（B错）对于下腹部成像有限。血常规（C错）对坐骨肛管间隙脓肿诊断无明确作用。下腹部结构复杂，肠管气体较多，影响腹部B超（D错）成像。